学校保护视力，预防近视的重点对象是
A. 所有在校的中小学生
B. 成绩优异的中小学生
C. 父母或家族中患有近视的中小学生
D. 体质孱弱或病后的中小学生
E. 未养成良好用眼卫生习惯的中小学生

正确答案：C。父母或家族中患有近视的中小学生